全口义齿试戴时，发现下列哪种情况需要重做
A. 义齿不稳定
B. 上下颌中线不对
C. 人工牙颜色不协调
D. 试咬合有疼痛
E. 垂直距离过高

正确答案：E。垂直距离过高

解析：本题考查全口义齿需要重做的情况。垂直距离过高（E对）（过大），肌肉张力增大，可使牙槽嵴因受压而吸收，且义齿容易脱位，而且咀嚼效能有所下降，需要重做。义齿不稳定（A错）、试咬合有疼痛（D错）进行调（牙合）磨改即可。上下颌中线不对（B错）、人工牙颜色不协调（C错）不影响功能，且有时需要进行个体化设计，避免义齿面容，故意这样设计，所以不需要重做。